药师应掌握处方中常用的外文缩写，“每晚”用药的缩写是
A. qid
B. qn.
C. prn
D. qd.
E. q4h

正确答案：B。qn.

解析：本题考查处方中常见的外文缩写及其含义。qn.（B对）为“每晚”用药的缩写。qid.（A错）：“每日4次”用药。prn（C错）：“必要时”用药。qd.（D错）：“每日”用药。q4h（E错）：“每4小时”用药。